男，36岁，1年来反复出现脓血便，抗生素系统治疗无效。结肠镜检查发现病变位于直肠和乙状结肠，粘膜弥漫性充血水肿，颗粒不平质脆，血管纹理消失，最可能的诊断是
A. 结肠癌
B. 溃疡性结肠炎
C. 细菌性痢疾
D. 克罗恩病
E. 肠结核

正确答案：B。溃疡性结肠炎

解析：中年男性患者，1年来反复出现脓血便（黏液脓血便是溃疡性结肠炎活动期的重要表现）。结肠镜检查：病变位于直肠和乙状结肠（溃疡性结肠炎的好发部位），黏膜弥漫性充血水肿，颗粒不平质脆，血管纹理消失（溃疡性结肠炎的结肠镜表现）。综合该患者的病史、结肠镜检查，考虑诊断为溃疡性结肠炎（B对）。结肠癌（P382）（A错）多见于老年患者，有黏液脓血便伴里急后重，但结肠镜检可见肠腔狭窄、黏膜皱襞破坏或结节性肿块。细菌性痢疾（C错）有黏液脓血便伴里急后重，但抗生素系统治疗有效，结肠镜下呈地图状溃疡。克罗恩病（P377）（D错）粪便多为糊状，一般无脓血和黏液，镜下特点为纵行溃疡、鹅卵石样改变。肠结核（P368）（E错）多有低热、盗汗、消瘦等结核毒血症状，结肠镜可发现回盲部黏膜充血、水肿、溃疡形成。